可通过提起阴茎使其消失
A. 尿道内口
B. 尿道外口
C. 尿道膜部
D. 尿道耻骨下弯
E. 尿道耻骨前弯

正确答案：E。尿道耻骨前弯

解析：当阴茎勃起或将阴茎向上提起时，耻骨前弯（E对）可变直而消失。耻骨下弯（D错）为固定不变的弯曲。